直接分解产生尿酸的是
A. I
B. X
C. A
D. T
E. U

正确答案：B。X